下列女性尿道的描述中，正确的是
A. 起于膀胱的输尿管口
B. 穿经尿生殖膈
C. 尿道内口有环行的尿道阴道括约肌
D. 末端开口于阴道前庭后部
E. 尿道内的管腔短而窄

正确答案：B。穿经尿生殖膈

解析：女性尿道管腔短而宽（E错），起于膀胱的尿道内口（A错），开口于尿道外口。尿道外口位于阴道口的前方，阴道前庭前部（D错），尿道阴道括约（C错）肌位于女性尿道穿过尿生殖膈处（B对），尿道内口周围为膀胱括约肌。